患者，50岁，排便时出血，量不多，肛门脱出肿物，如李子大小，表面色紫，微带白色，需用手推挤方能回纳，病已10年，近来加重，可能的诊断是
A. 直肠息肉
B. 直肠脱垂
C. 直肠癌
D. 二期内痔
E. 三期内痔

正确答案：E。三期内痔

解析：患者肛门脱出李子大小肿物已经10年，病史长，需用手推挤方能回纳，符合Ⅲ期内痔表现，痔核更大，大便时痔核脱出，甚至行走、咳嗽、喷嚏、站立时也会脱出，不能自行回纳，须用手推回，或平卧、热敷后才能回纳；便血不多或不出血（E对）。Ⅱ期内痔：痔核较大，大便时可脱出肛外，便后自行回纳（D错），便血或多或少。位置较高的小息肉一般无症状；低位带蒂息肉，大便时可脱出肛门外，小的能自行回纳，大的便后需用手推回，常伴有排便不畅、下坠，或有里急后重感。多发性息肉常伴腹痛、腹泻，排出血性黏液便，久之则体重减轻、体弱无力、消瘦、贫血等（A错）。直肠脱垂起病缓慢，以肠黏膜或肠管全层脱出为主要症状，脱出物为淡红色，可见放射状或环形黏膜皱襞（B错）。直肠癌，即锁肛痔，是发生在肛管直肠的恶性肿瘤，病至后期，肿瘤阻塞，肛门狭窄，排便困难，犹如肛门被锁（E错）。